患儿，出生4天。全身欠温，四肢发凉，臀及小腿等部位皮肤色暗发紫，皮肤僵硬不能捏起，面色晦暗，唇、舌暗红。治疗应首选
A. 四逆散
B. 理中汤
C. 生脉散
D. 八珍汤
E. 当归四逆汤

正确答案：E。当归四逆汤

解析：患儿以全身欠温，四肢发凉，臀及小腿等部位皮肤色暗发紫，皮肤僵硬不能捏起为特征，当属新生儿硬肿症。寒凝则气滞，气滞则血凝血瘀，产生全身欠温，四肢发凉，臀及小腿等部位皮肤色暗发紫， 面色晦暗，唇、舌暗红，寒侵腠理，肺气失宣，肌肤失调，则见皮肤僵硬不能捏起， 治以当归四逆汤，可温经散寒，活血通络（E对）。四逆散主治少阴病四逆，其人或咳或悸，小便不利，腹中痛或泄利下重者（A错）。理中汤主治脾胃虚寒证，症见自利不渴，呕吐腹痛，面色㿠白，四肢不温等（B错）。生脉散益气养阴，主治温热、暑热，耗气伤阴证及久咳伤肺，气阴两虚证（C错）。八珍汤气血双补，主治面色苍白或萎黄，头晕目眩，四肢倦怠，气短懒言，心悸怔忡（D错）。